结构中含有β-内酰胺环，通过抑制β-内酰胺酶，增加阿莫西林抗菌效果的药物是
A. 磺胺嘧啶
B. 氟康唑
C. 特比萘芬
D. 头孢克洛
E. 克拉维酸

正确答案：E。克拉维酸

解析：本题考查氧青霉烷类抗菌药。结构中含有β-内酰胺环，通过抑制β-内酰胺酶，增加阿莫西林抗菌效果的药物是克拉维酸（E对）。磺胺嘧啶（A错）为二氢叶酸合成酶的竞争性抑制剂，能通过血脑屏障进入脑脊液。氟康唑（B错）属于三唑类抗菌药。特比萘芬（C错）是丙烯胺类抗真菌药。头孢克洛（D错）是头孢氨苄的C-3位甲基被氯原子取代得到的可口服的半合成头孢菌素，由于氯原子的亲脂性比甲基强，口服吸收好。